关于早产的概念下列说法正确的是
A. 指妊娠满28周至不足37周间分娩者
B. 指妊娠满28周至不足38周间分娩者
C. 指妊娠不足260日分娩者
D. 指妊娠满28周分娩者
E. 指妊娠满25周至不足37周间分娩者

正确答案：A。指妊娠满28周至不足37周间分娩者